制备复方乙水杨酸片时分别制粒是因为
A. 三种主药一起产生化学变化
B. 为了增加咖啡因的稳定性
C. 三种主药一起湿润混合会使溶点下降，压片时出现熔融和再结晶现象
D. 为防止乙酰水杨酸水解
E. 此方法制备方便

正确答案：C。三种主药一起湿润混合会使溶点下降，压片时出现熔融和再结晶现象